生物半减期
A. 进入体内的毒物，通过代谢，排出体外的时间
B. 毒物进入体内，产生有害作用所需的时间
C. 进入体内的毒物，通过代谢和排出，存体内浓度减低一半所需要的时间
D. 毒物使动物的一半出现某种效应所需时间
E. 以上均不是

正确答案：C。进入体内的毒物，通过代谢和排出，存体内浓度减低一半所需要的时间